下面哪项属于学校预防性卫生监督的内容
A. 学校需采取的食品卫生
B. 学生文具
C. 学生课桌椅
D. 学校饮用水卫生
E. 学校地理位置

正确答案：A。学校需采取的食品卫生